属于酪氨酸激酶抑制剂的抗肿瘤药物是
A. 来曲唑
B. 环磷酰胺
C. 厄洛替尼
D. 长春新碱
E. 多柔比星

正确答案：C。厄洛替尼

解析：本题考查抗肿瘤药。属于酪氨酸激酶抑制剂的抗肿瘤药物是厄洛替尼（C对）。来曲唑（A错）属于芳香氨酶抑制剂，芳香氨酶抑制剂通过抑制芳香化酶的活性，阻断卵巢以外的组织雄烯二酮及睾酮经芳香化作用转化成雌激素，达到抑制乳癌细胞生长，治疗肿瘤的目的。环磷酰胺（B错）是直接破坏DNA结构的烷化剂，通过与细胞中DNA发生共价结合来使DNA分子失活或断裂，可以损坏任何细胞增殖周期的DNA，对细胞有直接毒性作用。长春新碱（D错）属于微管蛋白活性制剂的抗肿瘤药物。多柔比星（E错）为干扰转录过程和阻止RNA合成的药物，抗瘤谱广。